禽流感不引起致病的病毒是
A. H1
B. H2
C. H3
D. N2
E. N3

正确答案：E。N3

解析：人禽流感是甲型流感病毒某些亚型中的一些毒株引起的急性呼吸道感染。甲型流感病毒根据H和N抗原不同，又分为许多亚型，H可分为17个亚型（H1～H17），N有10个亚型（N1～N10），其中仅H1N1（A对）、H2N2（BD对）、H3N2（C对）主要感染人类引起致病，其它许多亚型如N3（E错，为本题正确答案）等的自然宿主是多种禽类和动物。